癫痫精神运动性发作选用
A. 乙琥胺
B. 苯妥英钠
C. 丙戊酸钠
D. 苯巴比妥
E. 卡马西平

正确答案：E。卡马西平

解析：本题考查癫痫的治疗药物选择。卡马西平是一种高效的广谱抗癫痫药，对各类型癫痫均有效，其中对精神运动性发作、大发作和单纯部分性发作疗效较好，对小发作和肌阵挛性发作效果差或无效。卡马西平（E对）是治疗精神运动性发作的首选药物。